记忆在脑力劳动处理信息起重要作用，信息首先以不稳定形式暂时地在大脑加以贮存，这种记忆称作
A. 暂时记忆
B. 长期记忆
C. 工作记忆
D. 第二级记忆
E. 第三级记忆

正确答案：C。工作记忆